患者，男，右下颌下区肿物3个月，检查见右下颌下区表面皮肤正常，触诊柔软，与皮肤无粘连，无压痛，低头时肿物稍有增大，口内检查亦未见异常。手术中见囊腔内流出蛋清样黏稠液体。根据上述症状，该患者最可能的诊断是
A. 右侧下颌下腺囊肿
B. 右侧下颌下囊性水瘤
C. 右侧舌下腺囊肿
D. 右侧鳃裂囊肿
E. 右侧下颌下腺炎

正确答案：C。右侧舌下腺囊肿

解析：舌下腺囊肿口外型主要表现为下颌下区肿物，而口底囊肿表现不明显。触诊柔软，与皮肤无粘连，不可压缩，低头时因重力关系，肿物稍有增大。穿刺可抽出蛋清样黏稠液体。掌握“舌下腺及唾液腺黏液囊肿”知识点。